困倦，缺氧或深度麻醉时出现
A. α波
B. β波
C. θ波
D. δ波
E. 以上均不是

正确答案：C。θ波